肺主气的含义之一是
A. 主一身之气
B. 主气向上向外
C. 主调节腠理开合
D. 主调节宣发卫气
E. 主调节汗液排泄

正确答案：A。主一身之气

解析：本题考查的是肺的生理功能。肺主气的含义之一是主一身之气（A对）。肺主气，司呼吸（1）肺主呼吸之气：肺是体内外气体交换的场所，人体通过肺，从自然界吸入清气，呼出体内的浊气，吐故纳新，使体内外的气体不断交换，从而保证了人体新陈代谢的正常进行。（2）肺主一身之气：肺吸入的清气与脾胃运化的水谷精气，在胸中相合生成宗气，贯心脉以行心血；并且，肺气的升降出入运动对全身气机具有调节作用，故“诸气者，皆属于肺”。肺的主要生理功能1.主宣发肃降，宣发，即宣布、发散，有向上、向外（B错）之意；肃降，即清肃、下降，有向下、向内之意。肺主宣发（D错）是指肺气具有向上升宣和向外周布散的作用；肺主肃降是指肺气具有向下、向内清肃通降的作用。2.主通调水道，肺主通调水道，是指肺气的宣发和肃降，对体内水液的输布和排泄（E错）具有疏通和调节作用。